百会穴在头正中线上，其具体位置在
A. 人前发际7寸
B. 人前发际5寸
C. 人后发际6寸
D. 头顶旋毛中
E. 两耳连线上

正确答案：B。人前发际5寸

解析：本题考查百会穴的定位。人体百汇穴位于头部，当前发际正中直上5寸，或两耳尖连线中点处。（B对）。其它选项均不符合题意（ACDE错）。